取功能性印模的目的是
A. 精确反映口周肌肉功能活动时的位置和形态
B. 使口腔组织受压均匀
C. 使印模边缘圆滑
D. 看清解剖标志
E. 边缘及黏膜转折处清晰

正确答案：A。精确反映口周肌肉功能活动时的位置和形态

解析：本题考查制取功能性印模的目的。功能性印模是在一定压力状态下取得的印模，也称压力性印模。取功能性印模的主要目的是能精确反应口周肌功能活动的位置和形态（A对），保证基托位移最小。对于缺牙区牙槽嵴有明显吸收，黏膜和黏膜下组织松软且动度较大的游离端缺失的病例，最好采用功能性印模技术，以弥补鞍基远端下沉过多的问题。因为基牙和牙槽嵴黏膜的可让性差异的存在并不能使口腔组织受压均匀（B错）。印模初步制取完成，大多数边缘会有一些多余的印模材料，需要再次进行修整才能使边缘圆滑（C错），与是否取功能印模无关。解剖式印模是用流动性好的印模材料制取，能准确记录牙和牙槽嵴的解剖形态在制作时还必须进行肌功能修整，因此取出的印模能清楚地看清解剖标志（D错），边缘以及黏膜转折处也比较清晰（E错）。